关于药物口服吸收影响因素的说法，正确的有
A. 对于难溶性固体药物药物的溶出可能是吸收的限速过程
B. 通常药物溶出后以分子形式分散在胃肠液中与生物膜接触才能产生吸收
C. 胃内容物体积及食物类型可影响药物吸收
D. 采用药物的稳定型晶型可加快溶出利于药物吸收
E. 通常未解离的分子型药物比其离子型药物易于透过生物膜

正确答案：A、B、C、E。对于难溶性固体药物药物的溶出可能是吸收的限速过程；通常药物溶出后以分子形式分散在胃肠液中与生物膜接触才能产生吸收；胃内容物体积及食物类型可影响药物吸收；通常未解离的分子型药物比其离子型药物易于透过生物膜

解析：本题考查的是影响药物口服给药吸收的主要因素。关于药物口服吸收影响因素的说法，正确的有对于难溶性固体药物药物的溶出可能是吸收的限速过程（A对）、通常药物溶出后以分子形式分散在胃肠液中与生物膜接触才能产生吸收（B对）、胃内容物体积及食物类型可影响药物吸收（C对）与通常未解离的分子型药物比其离子型药物易于透过生物膜（E对）。影响药物口服给药吸收的主要因素如下。（1）生理因素：①胃肠液的成分和性质：弱酸、弱碱性药物的吸收与胃肠液的pH有关。胃液的pH为1.0左右，有利于弱酸性药物的吸收，凡是影响胃液pH的因素均影响弱酸性药物的吸收。小肠部位肠液的pH通常为5～7，有利于弱碱性药物的吸收，大肠黏膜部位肠液的pH通常为8.3～8.4。此外，胃肠液中含有的胆盐、酶类及蛋白质等物质也可能影响药物的吸收，如胆盐具有表面活性，能增加难溶性药物的溶解度，有利于药物吸收，但有时也可能与某些药物形成难溶性盐而影响吸收。②胃排空速率：胃排空速率慢，有利于弱酸性药物在胃中的吸收。但小肠是大多数药物吸收的主要部位，因此，胃排空速率快，有利于多数药物吸收。影响胃排空速率的主要因素有胃内容物的体积、食物的类型、体位以及药物性质等。③其他：消化道吸收部位血液或淋巴循环的途径及其流量大小、胃肠本身的运动以及食物等，均可能影响药物的口服吸收。（2）药物因素：①药物的脂溶性和解离度：通常脂溶性大的药物易于透过细胞膜，未解离的分子型药物比离子型药物易于透过细胞膜。因此，消化道内药物的吸收速度常会受未解离型药物的比例及其脂溶性大小的影响，而未解离型药物的比例取决于吸收部位的pH。消化道吸收部位的药物分子型比例是由吸收部位的pH和药物本身的pKₐ决定的。通常弱酸性药物在胃液中，弱碱性药物在小肠中未解离型药物量增加，吸收也增加，反之则减少。②药物的溶出速度：通常固体制剂中药物需经过崩解、释放、溶解后方可通过生物膜被吸收。对于难溶性固体药物，药物的溶出可能是吸收的限速过程。因此，减小药物粒径、采用药物的亚稳定型晶型、制成盐类或固体分散体等方法，加快药物的溶出，可促进药物的吸收（D错）。（3）剂型因素：①固体制剂的崩解与药物溶出：固体制剂崩解成碎粒后，药物溶出，进而被吸收。因此，固体制剂的崩解是药物溶出和吸收的前提。通常，口服药物溶出后，以分子形式分散在胃肠液中与生物膜接触才能产生吸收。药物的溶出速度，也将影响药物的吸收。对于难溶性药物，溶出可能是药物吸收的限速过程。②剂型：剂型不同，其给药途径也不相同。通常不同给药途径的药物吸收显效快慢的顺序为：静脉＞吸入＞肌内＞皮下＞舌下或直肠＞口服＞皮肤；口服制剂药物吸收速度快慢的顺序是：溶液剂＞混悬剂＞胶囊剂＞片剂＞包衣片。③制剂处方及其制备工艺：制剂的处方因素主要包括主药和辅料的理化性质及其相互作用等。即使是同一药物制备同种剂型，由于所用辅料或制备工艺不同也会产生不同的吸收特征。